两组呈正态分布的数值变量资料，但均数相差悬殊，若比较离散趋势，最好选用的指标为
A. 全距
B. 四分位数间距
C. 方差
D. 标准差
E. 变异系数

正确答案：E。变异系数

解析：两组呈正态分布的数值变量资料，描述离散趋势的指标最好选用标准差（D错）而非方差（C错），但均数相差悬殊，若比较离散趋势，最好选用的指标是变异系数（E对）。变异系数的用途：①比较均数相差悬殊的几组资料的离散程度；②比较计量单位不同的几组资料的离散程度。全距（极差）（A错）通常仅用于粗略地说明变量的波动范围。四分位数间距（B错）作为说明个体差异的指标，与极差相比不易受极端值的影响，但仍未用到每一个具体的观察值，在统计分析中应用不够普遍。